牛膝具善下行之性，但不能用治的是
A. 腰膝酸痛
B. 口舌生疮
C. 气喘咳嗽
D. 难产胞衣不下
E. 阴虚阳亢眩晕

正确答案：C。气喘咳嗽

解析：牛膝味苦、甘、酸，性平，归肝肾二经。其功效为逐瘀通经，补肝肾，强筋骨，利尿通淋，引血下行。可用于治疗瘀血阻滞之经闭，痛经，胞衣不下（D对）；跌扑伤痛；腰膝酸痛（A对），筋骨无力；淋证，水肿，小便不利；气火上逆之吐血衄血、牙痛口疮（B对），阴虚阳亢之头痛眩晕（E对C错，为本题正确答案）。